位于豆状核和尾状核头部之间
A. 内囊前肢
B. 内囊后肢
C. 内囊膝
D. 听辐射
E. 无

正确答案：A。内囊前肢

解析：内囊前肢（A对）伸向前外，位于豆状核与尾状核之间；内囊后肢（B错）伸向后外，分为豆丘部、豆状核后部和豆状核下部；内囊膝（C错）介于前、后肢之间，即 V 字形转角处，听辐射（D错）经内囊后肢，止于大脑皮质。